根据《国务院关于改革药品医疗器械审评审批制度的意见》（国发〔2015〕44号），我国改革药品医疗器械审评审批制度的主要任务包括
A. 对已经批准上市的仿制药，按与原研药品质量和疗效一致的原则，分期分批进行一致性评价
B. 推行药品上市许可持有人制度，允许药品硏发机构和药品经营企业〕〔申请注册新药
C. 对创新药实行特殊审评审批制度，加快临床急需新药的审评审批
D. 提高药品审批标准，将新药界定由现行的“未在中国境内上市销售的药品”调整为“未在中国境内外上市销售的药品”

正确答案：A、C、D。对已经批准上市的仿制药，按与原研药品质量和疗效一致的原则，分期分批进行一致性评价；对创新药实行特殊审评审批制度，加快临床急需新药的审评审批；提高药品审批标准，将新药界定由现行的“未在中国境内上市销售的药品”调整为“未在中国境内外上市销售的药品”

解析：本题考查《国务院关于改革药品医疗器械审评审批制度的意见》。根据《国务院关于改革药品医疗器械审评审批制度的意见》（国发〔2015〕44号），我国改革药品医疗器械审评审批制度的主要任务包括对已经批准上市的仿制药，按与原研药品质量和疗效一致的原则，分期分批进行一致性评价（A对）；对创新药实行特殊审评审批制度，加快临床急需新药的审评审批（C对）；提高药品审批标准，将新药界定由现行的“未在中国境内上市销售的药品”调整为“未在中国境内外上市销售的药品”（D对）。《国务院关于改革药品医疗器械审评审批制度的意见》主要任务：（六）提高药品审批标准。将药品分为新药和仿制药。将新药由现行的“未曾在中国境内上市销售的药品”调整为“未在中国境内外上市销售的药品”。根据物质基础的原创性和新颖性，将新药分为创新药和改良型新药。将仿制药由现行的“仿已有国家标准的药品”调整为“仿与原研药品质量和疗效一致的药品”。（七）推进仿制药质量一致性评价。对已经批准上市的仿制药，按与原研药品质量和疗效一致的原则，分期分批进行质量一致性评价。（八）加快创新药审评审批。对创新药实行特殊审评审批制度。加快审评审批防治艾滋病、恶性肿瘤、重大传染病、罕见病等疾病的创新药，列入国家科技重大专项和国家重点研发计划的药品，转移到境内生产的创新药和儿童用药，以及使用先进制剂技术、创新治疗手段、具有明显治疗优势的创新药。加快临床急需新药的审评审批，申请注册新药的企业需承诺其产品在我国上市销售的价格不高于原产国或我国周边可比市场价格。（九）开展药品上市许可持有人制度试点。允许药品研发机构和科研人员申请注册新药（B错），在转让给企业生产时，只进行生产企业现场工艺核查和产品检验，不再重复进行药品技术审评。试点工作在依照法定程序取得授权后开展。（十）落实申请人主体责任。（十一）及时发布药品供求和注册申请信息。（十二）改进药品临床试验审批。（十三）严肃查处注册申请弄虚作假行为。（十四）简化药品审批程序，完善药品再注册制度。（十五）改革医疗器械审批方式。（十六）健全审评质量控制体系。参照国际通用规则制定良好审评质量管理规范。（十七）全面公开药品医疗器械审评审批信息。